食管癌发病危险因素的病例对照被研究时，为减少因研究对象回忆不准确而收集错误应使用以下哪种信息
A. 现患病例
B. 死亡病例
C. 现存病例
D. 住院病例
E. 新发病例

正确答案：E。新发病例

解析：因研究对象回忆不准确而收集错误为信息偏倚中的回忆偏倚，所以应使用新发病例。